患者的自主性取决于
A. 医患之间的契约关系
B. 医患之间的经济关系
C. 医患之间的政治关系
D. 医患之间的亲疏关系
E. 医患之间的工作关系

正确答案：A。医患之间的契约关系

解析：从法律上说，医患关系是一种医疗契约关系，不过，这种契约关系与一般的契约关系不完全相同，如这种契约没有订立一般契约的相关程序和条款、对患者一方没有严格的约束力等。因此，医患关系具有契约性，但并不是一种严格的契约关系。掌握“医患关系伦理”知识点。